中药处方对饮片的调配、煎法、用法等方面的特殊要求，常以脚注形式体现用时需捣碎的中药饮片有
A. 丁香
B. 补骨脂
C. 川楝子
D. 五味子
E. 豆蔻

正确答案：A、C、D、E。丁香；川楝子；五味子；豆蔻

解析：本题考查的是中药处方用药适宜性。中药处方对饮片的调配、煎法、用法等方面的特殊要求，常以脚注形式体现用时需捣碎的中药饮片有丁香（A对）、川楝子（B对）、五味子（D对）、豆蔻（E对）。丁香、川楝子、五味子、豆蔻均需用时捣碎。